半夏与天南星的共同主治是
A. 湿痰
B. 便秘
C. 呕吐
D. 吐血
E. 中风

正确答案：A。湿痰

解析：本题考查半夏与天南星的功效应用及鉴别。半夏味辛性温，善燥除湿浊而化痰饮，并有止咳作用，为燥湿化痰、温化寒痰之要药，尤善治脏腑湿痰；天南星味苦辛性温，其温燥之性胜于半夏，有较强的燥湿化痰之功，治寒痰、湿痰阻肺（A对）。便秘、吐血是两者都不具备的功效（BD错）；呕吐是半夏具备，天南星不具备的功效（C错）；中风是天南星具备半夏不具备的功效（E错）。